腕横纹尺侧端，尺侧腕屈肌腱桡侧凹陷中的腧穴是
A. 神门
B. 大陵
C. 列缺
D. 太渊
E. 内关

正确答案：A。神门

解析：该题考查穴位准确定位。神门为手少阴心经腧穴，位于腕横纹尺侧端，尺侧腕屈肌腱的桡侧凹陷处（A对）。大陵为手厥阴心包经腧穴，位于腕横纹中央，掌长肌腱及桡侧腕屈肌腱之间（B错）。列缺为手太阴肺经腧穴，位于桡骨茎突上方，腕横纹上1.5寸，当肱桡肌与拇长展肌腱之间，简便取穴法：两手虎口自然平直交叉，一手食指按在另一手桡骨茎突上，指尖下凹陷中是穴（C错）。太渊为手太阴肺经腧穴，位于腕掌侧横纹桡侧，桡动脉的桡侧凹陷中（D错）。内关为手厥阴心包经腧穴，位于腕横纹上2寸，掌长肌腱桡侧腕屈肌腱之间（E错）。记忆：在腕横纹上的穴位从尺侧到桡侧依次是，神门、大陵、太渊。